患者男性，12岁，肺动脉瓣区听到3/6级收缩期杂音，同时听到不受呼吸影响的明显第二心音分裂。该患者可能是
A. 正常人
B. 肺动脉瓣狭窄
C. 房间隔缺损
D. 二尖瓣狭窄
E. 肺动脉瓣关闭不全

正确答案：C。房间隔缺损

解析：患者青少年男性，肺动脉瓣区听到3/6级收缩期杂音，同时听到不受呼吸影响的明显第二心音分裂（提示呈固定分裂），该患者可能是房间隔缺损（C对）。正常人（A错）偶可闻及杂音，但通常不超过2/6级。肺动脉瓣狭窄（B错）虽可于胸骨左缘第二肋间（肺动脉瓣区）闻及收缩期杂音，但一般可听到受呼吸影响的第二心音通常分裂（九版诊断学P151）。二尖瓣狭窄（P287）（D错）特征性杂音为心尖区舒张中晚期低调的隆隆样杂音。肺动脉瓣关闭不全（E错）可在肺动脉瓣区听到舒张期叹气样高调递减型杂音。